正确的是
A. 分体、大翼、小翼和翼突等4部
B. 大翼上从前向后有圆孔、卵圆孔和棘孔
C. 视神经管在小翼与体的交界处
D. 大翼与小翼之间是眶上裂
E. 以上均正确

正确答案：E。以上均正确

解析：蝶骨形似展翅的蝴蝶，居颅底中央，分体、大翼、小翼和翼突四部（A对）。大翼根部自前内向后外可见圆孔、 卵圆孔和棘孔（B对） ,分别通过重要的神经和血管。小翼与体的交界处可见视神经管（C对）。小翼与大翼间的裂隙为眶上裂（D对）。因此以上选项全对（E为本题正确答案）。